孕妇在妊娠晚期合并急性病毒性肝炎，应给予重视和积极治疗，主要是因为
A. 容易合并妊高征及发生子痫
B. 容易发展为重症肝炎，孕产妇死亡率增高
C. 容易发生糖代谢障碍，影响胎儿发育
D. 容易发生早产，胎儿不易存活
E. 容易发生宫缩乏力，产程延长

正确答案：B。容易发展为重症肝炎，孕产妇死亡率增高